室内空气主要污染源的室外来源包括
A. 室外空气、建筑物自身、相邻住宅污染
B. 室外空气、建筑物自身、人为带入室内
C. 室外空气、建筑物自身、人为带入室内、生活用水污染
D. 室外空气、人为带入室内、生活用水污染、相邻住宅污染
E. 室外空气、建筑物自身、相邻住宅污染、人为带入室内、生活用水污染

正确答案：E。室外空气、建筑物自身、相邻住宅污染、人为带入室内、生活用水污染

解析：本题考查室内空气主要污染源的室外来源。根据污染物形成的原因和进入室内的途径，可将室内空气主要污染源分为室外来源和室内来源。其中室外来源包括：室外空气、建筑物自身、相邻住宅污染、人为带入室内、生活用水污染（E对ABCD错）。室内来源包括：室内燃烧或加热、室内活动、室内装饰材料及家具、室内生物性污染、家用电器。